三叉神经病人疼痛部位在一侧眶下及上唇区者，其诊断为三叉神经
A. 第一支痛
B. 第二支痛
C. 第三支痛
D. 第一、二支痛
E. 第二、三支痛

正确答案：B。第二支痛

解析：本题考查三叉神经痛的临床检查-定分支检查。三叉神经病人疼痛部位在一侧眶下及上唇区者，其诊断为三叉神经第二支痛（B对）。三叉神经第二支痛表现在眶下孔、下眼睑、鼻唇沟、鼻翼、上唇、鼻孔下方或口角区、上颌结节或腭大孔等部位疼痛，该患者的疼痛部位符合第二支痛的特点。第一支痛（AD错）表现在眶上孔、上眼睑、眉、额、颞等部位疼痛。第三支痛（CD错）表现在颏孔、下唇、口角区、耳屏部、颊黏膜、颊脂垫尖等部位疼痛。